柯克朗数据库所收集的信息是
A. 药学信息
B. 药物信息
C. 遗传信息
D. 循证药物信息
E. 信息科学

正确答案：D。循证药物信息